在制备蛋白质多肽类药物冷冻干燥制剂时，一般不需加入
A. 甘露醇
B. 蔗糖
C. 葡萄糖
D. 异丙醇
E. 右旋糖酐

正确答案：D。异丙醇

解析：本题考查固体状态蛋白质类药物的稳定性与工艺。在制备蛋白质多肽类药物冷冻干燥制剂时，一般不需加入异丙醇（D错，为本题正确答案）。在蛋白质类药物冻干过程中常加入某些冻干保护剂来改善产品的外观和稳定性，如甘露醇（A对）、山梨醇、蔗糖（B对）、葡萄糖（C对）、右旋糖酐（E对）等。